形成岩的主要病机是
A. 邪气偏盛
B. 阴阳失调
C. 阴毒结聚
D. 正气不足
E. 经络阻塞

正确答案：D。正气不足

解析：该题考查岩的病因病机。形成岩的主要病机为正气不足。岩是发生于体表的恶性肿物的统称。可知岩是虚证因此是正气不足（D对）。